下列哪项不符合SLE的血液系统改变
A. 白细胞减少
B. 血小板减少
C. 自身免疫性溶血性贫血
D. 正常细胞性贫血
E. 类白血病样改变

正确答案：E。类白血病样改变

解析：活动性的SLE分别可见血红蛋白下降、白细胞和（或）血小板减少，其中10%属于Coombs试验阳性的溶血性贫血，也有正常细胞性贫血（ABCD错）。而类白血病样改变常并发于严重感染、恶性肿瘤等基础疾病，并有相应原发病的临床表现，符合题意（E对）。